关于尺骨的叙述，下列哪项是正确的？
A. 鹰嘴突向前下方，伸肘时进人鹰嘴窝内
B. 冠突突向后上方，屈肘时进人冠突窝内
C. 桡切迹位于冠突的外侧面
D. 伸肘时尺骨鹰嘴肱骨内、外上髁成等腰三角形
E. 无

正确答案：C。桡切迹位于冠突的外侧面

解析：鹰嘴突向前上方，伸肘时进人鹰嘴窝内 (A错)。冠突外侧面有桡切迹，与桡骨头相关节（C对）。当肘关节伸直时，此三点位于一条直线上，当肘关节屈至 90° 时，此三点的连线构成一尖端朝下的等腰三角形 (D错)。